下列哪项不是急性肾炎的临床特征
A. 多数病人都有血尿
B. 病程早期常有高血压
C. 部分病例可出现急性肾功能不全
D. 血压急剧升高时可出现高血压脑病
E. 浮肿为可凹性、上行性

正确答案：E。浮肿为可凹性、上行性

解析：急性肾小球肾炎，其典型临床表现为：浮肿、血尿、少尿、蛋白尿及高血压，严重表现为严重的循环充血、高血压脑病（D对）和急性肾功能不全（C对）。浮肿为早期最常见的症状，自颜面眼睑开始，1～2日渐及全身，呈非凹陷性、下行性（E错，为本题正确答案）。几乎所有病例都有镜下血尿，50%～70%病例有肉眼血尿，而血尿包括镜下血尿和肉眼血尿，故多数病人都有血尿（A对）是急性肾炎的临床特征。病程早期30%～80%患儿有高血压，在1～2周后随尿量增多血压可逐渐降低（B对）。